女性，22岁。半年来常感脐周或右下腹痛，伴间歇腹泻，粪便呈糊状，无脓血，右下腹有压痛。全胃肠钡餐检查：回肠末端及盲肠有多段肠曲肠腔狭窄，边缘不整齐，病变之间肠曲正常。最可能的诊断为
A. 克罗恩病
B. 肠结核
C. 结肠癌
D. 溃疡性结肠炎
E. 阿米巴性肉芽肿

正确答案：A。克罗恩病

解析：慢性反复发作性右下腹或脐周痛与腹泻、腹块、发热等表现，X线或（和）结肠镜检查发现肠道炎症性病变主要在回肠末段与邻近肠段且呈节段性分布者，应考虑克罗恩病的诊断。掌握“炎症性肠病（克罗恩病、溃疡性结肠炎）”知识点。